一项筛检试验能将实际有病的人正确判为患者的能力称为
A. 特异度
B. 灵敏度
C. 可靠性
D. 一致性
E. 真实性

正确答案：B。灵敏度